下列哪项能够反映一组性质相同的观察值的平均水平或集中趋势的统计指标
A. 标准差
B. 标准误
C. 平均数
D. 可信区间
E. 构成比

正确答案：C。平均数

解析：平均数：分析计量资料常用平均数，它是反映一组性质相同的观察值的平均水平或集中趋势的统计指标。掌握“口腔健康状况调查数据的整理和统计”知识点。